什么结构能够使结合上皮与牙表面紧密附着
A. 透明板和密板
B. 微绒毛
C. 胶原纤维
D. 桥粒
E. 半桥粒

正确答案：E。半桥粒

解析：结合上皮细胞在牙表面产生一种基板样物质（包括密板和透明板两部分），并能通过半桥粒附着在这些物质上。掌握“牙龈”知识点。